培养钩端螺旋体的最佳温度是
A. 20℃
B. 24℃
C. 28℃
D. 35℃
E. 37℃

正确答案：C。28℃

解析：钩端螺旋体在致病性钩体人工培养生长缓慢，常用柯氏培养基（内含8%兔血清）。专性需氧或微需氧，pH7.4，28℃左右培育1～2周，在液体培养基中呈半透明云雾状生长。掌握“概述及梅毒螺旋体”知识点。